高血压、糖尿病、恶性肿瘤以及空调综合征、电脑综合征等被称为
A. 环境污染
B. 生活方式
C. 现代文明病
D. 心理健康
E. 人口流动

正确答案：C。现代文明病